白喉棒状杆菌具有
A. 荚膜
B. 芽胞
C. 鞭毛
D. 菌毛
E. 异染颗粒

正确答案：E。异染颗粒